能提高中药制中挥发性成分稳定性的技术是
A. β-环糊精包合
B. 药物微粉化
C. 流化喷雾制粒
D. 喷雾干燥制粒
E. 大孔树脂吸附

正确答案：A。β-环糊精包合

解析：本题考查的是环糊精包合物的作用。能提高中药制中挥发性成分稳定性的技术是β-环糊精包合（A对）。环糊精包合物的作用：提高药物的稳定性。增加药物的溶解度。减少药物的刺激性，掩盖不良气味。调节药物的释放速度。使液体药物粉末化而便于制剂。药物微粉化（B错）的作用：改善口服制剂的药物溶出度，提高生物利用度。靶向和定位释药。药物控释。流化喷雾制粒（C错）的作用：集混合、制粒、干燥于一体，制粒结束后，对于混合均一性、颗粒水分含量均能满足要求，颗粒外观均匀，形状近似于球形，流动性较好，整个制粒过程均在一个密闭负压的环境中完成，有效的防止了粉末的飞扬，对生产环境和人员影响较小。喷雾干燥制粒（D错）的作用：水作为喷雾干燥制粒的溶剂，应用最为广泛，其主要优点是安全价廉，但不能溶解水不溶性辅料。通常被喷雾干燥的物质混悬或溶解于水中。但水的蒸发整速度也慢，因此我们常常也会使用有机溶剂，如醇类，如甲醇、异丙醇等。虽然有机溶剂挥发迅速，但空气流中混有大量挥发溶剂，有爆炸危险及毒性。大孔树脂吸附（E错）作用是依靠它和被吸附的分子（吸附质）之间的范德华引力，通过它巨大的比表面进行物理吸附而工作，使有机化合物根据有吸附力及其分子量大小可以经一定溶剂洗脱分开而达到分离、纯化、除杂、浓缩等不同目的。